患者，女，24岁，已婚。产后10天，高热3天，下腹疼痛拒按，恶露量少、色紫黯，有臭味，烦热渴饮，尿黄便结，舌红苔黄厚，脉滑数。其证候是
A. 外感风热
B. 阴虚内热
C. 血热
D. 血瘀
E. 感染邪毒

正确答案：E。感染邪毒

解析：患者产后10天高热三天，邪正交争剧烈，故高热，下腹疼痛拒按，恶露量少，色紫黯，有臭味，是因为邪毒入胞，与瘀血互结，阻滞胞脉故小腹疼痛拒按，恶露排除不畅，热毒熏蒸，故色如败酱，气臭秽；烦热渴饮，尿黄便结，舌红苔黄厚均为邪毒內燔之象（E对）。外感风热常见恶风寒，发热，汗出，脉浮数，苔薄黄，或有鼻塞、流浊涕、喷嚏，或咽喉痒痛等表证之象（A错）。阴虚内热常见以咽干，五心烦热，盗汗，脉细数为主要表现的虚热证候（B错）。血热证以身热口渴，斑疹吐衄，烦躁谵语，舌绛，脉数等为主要表现的实热证候（C错）。血瘀证以固定刺痛、肿块、出血、瘀血色脉征为主要表现的证候（D错）。